正常人呼吸与脉搏之比为
A. 1:1
B. 1:2
C. 1:3
D. 1:4
E. 1：5

正确答案：D。1:4

解析：正常人呼吸频率为12～20次/分，呼吸与脉搏之比为1:4（D对）。